在一次食物中毒事件中，共有200人用餐，其中有80人出现急性胃肠炎症状。对这80人的进食情况进行了分析，发现其中多数人吃了凉拌黄瓜。据此调查者认为凉拌黄瓜是最可能的致病食物。此结论
A. 正确
B. 不正确，因为没有进行统计学显著性检验
C. 不正确，因为缺乏严格的对照组
D. 不正确，因为未用率作比较
E. 不正确，因为未进行年龄标化

正确答案：D。不正确，因为未用率作比较